以下对金属烤瓷全冠牙体预备的要求叙述正确的是
A. 前牙切端至少预备1.5～2.0mm间隙
B. 肩台宽度一般为1.0mm
C. 各轴面角无倒凹，各线角圆钝
D. 各轴面预备出金属厚度0.5mm，瓷厚度0.85～1.2mm
E. 以上都对

正确答案：E。以上都对

解析：本题考查对金属烤瓷全冠牙体预备的要求。前牙牙体预备一般正常情况下应达到以下标准：1.前牙切端至少预备1.5～2.0mm间隙（A对），上颌前牙切缘预备成与牙长轴呈45°且向腭侧形成小斜面，下颌前牙切缘要求同上颌牙，但切缘斜面斜向舌侧。近远中方向与牙弓平行。2.唇面除颈缘外，从牙体表面均匀磨除1.2～1.5mm的牙体组织，但牙冠切1/4向舌侧倾斜10°～15°保证前伸不受干扰，并在牙冠唇面切1/3磨除少许以保证切缘瓷层厚度和透明度。3.邻面各轴面角无倒凹，各线角圆钝（C对），预备出金瓷修复间隙保证颈部肩台预备外，还应保持邻面适当的切向聚合度2°～5°，一侧邻面切割量通常上颌前牙为1.8～2.0mm 以上，下颌前牙为1.0～1.6mm，各轴面预备出金属厚度0.5mm，瓷厚度0.85～1.2mm（D对）。4.舌面通常预备均匀磨除0.8～1.5mm，但颈1/3部应保持2°～5°切向聚合的颈圈，以增加全冠的固位力。5.唇面颈部肩台的外形要求：唇面及邻面的预备修复体的边缘一般放在龈下0.5～0.8mm的位置。后牙预备的要求：后牙PFM全冠牙体预备的要求与铸造全冠及前牙烤瓷全冠相近。前磨牙面通常设计为瓷覆盖，故面降低厚度2.0mm，少数情况下也可设计成瓷颊面。肩台宽度一般为1.0mm（B对），牙面在牙尖交错位、前伸牙合、侧方牙合时各牙尖嵴和斜面，特别是功能尖应保证足够的修复间隙。综上所述，以上均正确(E对，为本题正确答案）。